患者，女，28岁，已婚。颈前肿物10余年，渐渐增大，边缘不清，皮色如常，无疼痛，可触及肿物表面结节，随吞咽上下移动。其诊断是
A. 肉瘿
B. 石瘿
C. 瘿痈
D. 气瘿
E. 血瘿

正确答案：D。气瘿

解析：该患者为年轻女性，其病史、临床表现与体征符合气瘿的特点：颈前喉结一侧或两侧结块，柔韧而圆，如肉之团，随吞咽动作而上下移动，边界不清，质软不痛（D对）。石瘿为颈部的恶性肿瘤，其特征为颈中两侧结块，坚硬如石，高低不平，不能随吞咽动作而上下移动（B错）。瘿痈是颈前结喉两侧炎症性肿块性疾患，表现为颈前两侧结块，局部肿胀木硬、色红、灼热、疼痛（C错）。肉瘿其患部肿块多呈球形，边界清楚，质地柔软（A错）。血瘿多属颈部血管瘤、颈部动脉体瘤，或肿大的甲状腺压迫深部静脉，引起颈部浅表静脉扩张的合并症（E错）。